与受体有很高亲和力，但缺乏内在活性（α=0），与激动药合用，在增强激动药的剂量或浓度时，激动药的量-效曲线平行右移，但最大效应不变的药物是
A. 完全激动药
B. 竞争性拮抗药
C. 部分激动药
D. 非竞争性拮抗剂
E. 负性激动药

正确答案：B。竞争性拮抗药

解析：本题考查作用于受体药物的分类。与受体有很高亲和力，但缺乏内在活性（α=0），与激动药合用，在增强激动药的剂量或浓度时，激动药的量-效曲线平行右移，但最大效应不变的药物是竞争性拮抗药（B对）。竞争性拮抗剂具有较强的亲和力，能与受体结合，但缺乏内在活性（α=0）。可与激动剂竞争相同的受体，且其拮抗作用可逆，与激动剂合用时的效应取决于两者的浓度和亲和力。随着拮抗剂浓度增加，激动剂的累计浓度-效应曲线平行右移；随着激动剂浓度增加，最大效应不变。完全激动药（A错）有很大的亲和力和内在活性（α=1），能与受体结合并产生最大效应。部分激动药（C错）具有较强亲和力，但内在活性低（α＜1），与受体结合后只能产生较弱的效应。非竞争性拮抗剂（D错）与激动药合用，不断提高激动剂浓度，也不能达到单独使用激动剂时的最大效应。非竞争性拮抗剂可使激动剂的量小曲线右移，最大效应降低。负性激动药（E错）是指引起与原来的激动药相反的生理效应。